早期青少年牙周炎特征性表现不包括
A. 牙龈出血
B. 好发于青春期至25岁的青少年
C. 菌斑、牙石量少，牙龈炎症轻微，却已有深牙周袋
D. X线片可见第一磨牙形成典型的“弧形吸收”
E. 早期出现牙齿松动和移位

正确答案：A。牙龈出血

解析：本题考查局限侵袭性牙周炎的临床表现。牙龈出血（A错，为本题的正确答案）为所有牙龈炎、牙周炎的临床表现，不是早期青少年牙周炎特征性表现。青少年牙周炎又称侵袭性牙周炎，其临床表现有发病年龄较早一般好发于青春期至25岁的青少年（B对）。牙周破坏程度与局部刺激物的量不成比例，患者菌斑、牙石少，牙龈炎症轻微，但已有邻面深牙周袋（C对）和牙槽骨破坏。早期出现牙齿松动和移动，在炎症不明显的情况下，切牙出现扇形移位（E对）。X线片可见第一磨牙的邻面有垂直型骨吸收，若近远中均有垂直型骨吸收则形成“弧形吸收”（D对）。